骨髓功能缺陷会导致
A. 分散免缺陷或联合免疫缺陷
B. 体液免缺陷或脑液免疫缺陷
C. 体液免缺陷或联合免疫缺陷
D. 脑液免缺陷或联合免疫缺陷
E. 联合免疫缺陷

正确答案：C。体液免缺陷或联合免疫缺陷

解析：骨髓功能缺陷会导致体液免缺陷或联合免疫缺陷。掌握“中枢和外周免疫器官”知识点。